有关O₃的说法，哪项是不正确的
A. 属于二次污染物
B. 易进入呼吸道深部
C. 来自汽车尾气
D. 可引起哮喘发作
E. 儿童对O₃敏感

正确答案：C。来自汽车尾气

解析：本题考查O₃的相关内容。O₃是光化学烟雾主要成分（C错，为本题正确答案），其刺激性强并有强氧化性，属于二次污染物（A对）。光化学烟雾是大气中的NO₂和VOC，在太阳紫外线作用下，经过光化学反应形成的浅蓝色烟雾，是一组混合污染物。O₃的水溶性较小，易进入呼吸道的深部（B对）。人短期暴露于高浓度O₃可出现呼吸道症状、肺功能改变、气道反应性增高以及呼吸道炎症反应。有研究显示，儿童等敏感人群在120μg/m³的O₃下暴露8小时就可出现肺功能指标下降（E对）。大气中的O₃为210～1070μg/m³时可引起哮喘发作（D对），导致上呼吸道疾病恶化，并刺激眼睛，使视觉敏感度和视力下降。